通过加热炮制，降低毒性的药材是
A. 五味子
B. 雄黄
C. 商陆
D. 柴胡
E. 党参

正确答案：C。商陆

解析：本题考查的是醋制的主要目的。通过加热炮制，降低毒性的药材是商陆（C对）。醋炙法：将净选或切制后的药物，加入定量米醋拌炒至规定程度的方法。醋炙的主要目的：①降低毒性，缓和药性。如甘遂、京大戟、芫花、商陆等。②引药入肝，增强活血止痛作用。如乳香、没药、三棱、莪术等。③矫臭矫味。如乳香、没药、五灵脂等。五味子（A错）经蒸制后可增强疗效。雄黄（B错）经水飞后，雄黄粉达到极细和纯净，毒性降低，便于制剂。用于疮疖疔毒，疥癣，蛇虫咬伤，疟疾等。柴胡（D错）经醋制后升散之性缓和，疏肝止痛的作用增强。多用于肝郁气滞的胁肋胀痛，腹痛及月经不调等症。党参（E错）经蜜炙可增强补脾益气的作用。